表面黄红色至棕红色，具刀削痕，常见纵向裂缝的药材是
A. 鸡血藤
B. 降香
C. 沉香
D. 苏木
E. 大血藤

正确答案：D。苏木

解析：本题考查的是苏木药材的性状鉴别特征。表面黄红色至棕红色，具刀削痕，常见纵向裂缝的药材是苏木（D对）。苏木：【性状鉴别】药材呈长圆柱形或对剖半圆柱形。表面黄红色至棕红色，具刀削痕，常见纵向裂缝。质坚硬，断面略具光泽，年轮明显，有的可见暗棕色、质松、带亮星的髓部。气微，味微涩。鸡血藤（A错）：【性状鉴别】药材呈椭圆形、长矩圆形或不规则的斜切片。栓皮灰棕色，有的可见灰白色斑块，栓皮脱落处显红棕色。质坚硬。切面木部红棕色或棕色，导管孔多数；韧皮部有树脂状分泌物呈红棕色至黑棕色，与木部相间排列呈数个同心性椭圆形环或偏心性半圆形环；髓部偏向一侧。气微，味涩。降香（B错）：【性状鉴别】药材呈类圆柱形或不规则块状。表面紫红色或红褐色，切面有致密的纹理。质硬，有油性。气微香，味微苦。沉香（C错）：【性状鉴别】药材呈不规则块状、片状或盔帽状，有的为小碎块。表面凹凸不平，有刀削痕，偶有孔洞，可见黑褐色树脂与黄白色木部相间的斑纹、孔洞及凹窝。表面多呈朽木状。质较坚实，断面刺状。气芳香，味苦。大血藤（E错）：【性状鉴别】药材呈圆柱形，略弯曲。表面灰棕色，粗糙，外皮常呈鳞片状剥落，剥落处显暗红棕色，有的可见膨大的节及略凹陷的枝痕或叶痕。质硬，断面皮部红棕色，有数处向内嵌入木部，木部黄白色，有多数细孔状导管，射线呈放射状排列。气微，味微涩。